猫头鹰细胞对以下疾病具有诊断价值的是
A. 尖锐湿疣
B. 钩端螺旋体病
C. 巨细胞病毒感染
D. 生殖器疱疹
E. 梅毒

正确答案：C。巨细胞病毒感染

解析：巨细胞病毒感染后的细胞行吉姆萨染色，可见到细胞核变大，有包涵体形成，核内包涵体周围与核膜间有一“轮晕”，因而被称为猫头鹰细胞，故答案选C。